将因种种原因脱位的牙经处理后，原位植入牙槽窝内，这种方法称为
A. 自体移植
B. 异体移植
C. 牙再植术
D. 烤瓷冠修复
E. 牙种植术

正确答案：C。牙再植术

解析：牙再植术是将因种种原因脱位的牙经处理后，原位植入牙槽窝内。牙种植术是指将人工材料制作的牙根种植在牙槽内的手术。掌握“牙槽外科”知识点。